属循环系统疾病问诊内容的是
A. 呼吸困难
B. 呕吐
C. 腰痛
D. 肌肉震颤
E. 腹泻

正确答案：A。呼吸困难

解析：循环系统疾病主要症状为：呼吸困难（A对）、心悸、咳嗽、咯血、水肿及心前区疼痛等。呼吸困难、咳嗽、咳痰、咯血、胸痛为呼吸系统疾病的主要症状。呕吐（B错）和腹泻（E错）为消化系统疾病主要症状。腰痛（C错）主要为泌尿系统疾病症状。肌肉震颤（D错）为神经系统疾病、内分泌系统疾病症状。